氟喹诺酮类药对厌氧菌均呈天然耐药性，但属例外的是
A. 氧氟沙星
B. 洛美沙星
C. 环丙沙星
D. 诺氟沙星
E. 左旋氧氟沙星

正确答案：E。左旋氧氟沙星